冠心病心绞痛气阴两虚证的治法是
A. 益气温阳，宁心安神
B. 益气养阴，宁心复脉
C. 养心壮胆，安神定悸
D. 养心滋肾，宁神复脉
E. 益气补血，宁心定悸

正确答案：B。益气养阴，宁心复脉

解析：冠心病心绞痛气阴两虚证治疗需益气养阴，宁心复脉（B对）。益气温阳，宁心安神（A错）治疗阳虚不寐。养心壮胆，安神定悸（C错）治疗心胆气虚证。养心滋肾，宁神复脉（D错）治疗心肾阴虚证。益气补血，宁心定悸（E错）治疗气血两虚证。